男孩，10个月，诊断为“化脓性脑膜炎”，青霉素加氯霉素治疗10天，病情好转，体温正常，近3天又出现发热，抽搐，前囟饱满，颅缝分离，应首先考虑并发
A. 脑性低钠血症
B. 脑水肿
C. 硬脑膜下积液
D. 脑室管膜炎
E. 脑积水

正确答案：C。硬脑膜下积液

解析：该患儿诊断“化脓性脑膜炎”，有效抗生素治疗后好转，3天后又出现发热，抽搐，前囟饱满，发生在1岁以下婴儿，凡经化脓性脑膜炎有效治疗48～72小时后脑脊液有好转，但体温不退或体温下降后再升高，或一般症状好转后又出现意识障碍、惊厥、前囟隆起、颅缝分离或颅压增高等症状，首先应怀疑硬脑膜下积液的可能性（C对E错）。炎症刺激神经垂体致抗利尿激素过量分泌，引起低钠血症和血浆低渗透压，可能加剧脑水肿，致惊厥和意识障碍加重，或直接因低钠血症引起惊厥发作（A错）。脑室管膜炎主要发生在治疗被延误的婴儿。患儿在有效抗生素治疗下发热不退、惊厥、意识障碍不改善（D错）。